下6髓角最高的是
A. 近中颊侧髓角
B. 远中髓角
C. 近中舌侧髓角
D. 远中舌侧髓角
E. 近中髓角

正确答案：C。近中舌侧髓角

解析：本题考查恒牙髓腔的解剖形态。下6髓角最高的是近中舌侧髓角（C对）。下颌第一磨牙髓室约呈矮立方形，近远中径＞颊舌径＞髓室高度（约lmm）；髓室顶形凹，最凹处约与颈缘平齐，近舌髓角与远舌髓角高度相近，两者均接近牙冠中1/3。近颊髓角、远颊髓角和远中髓角较低，位于牙冠颈1/3或颈缘附近。